女，36岁。间断腹痛、腹泻5年，大便3～5次/日，带黏液，无脓血，便后胀痛缓解，受凉及紧张后症状加重，无发热，抗生素治疗无效。体重无减轻。粪隐血试验阴性。为确定诊断，首选的检查是
A. 结肠镜
B. 粪细菌培养
C. 腹部CT
D. 小肠X线钡剂造影
E. 腹部B型超声

正确答案：A。结肠镜

解析：中年女性患者，间断腹痛、腹泻5年（病程6个月以上），大便3～5次/日（排便频率异常），带黏液（粪便性状异常），无脓血（肠易激综合征患者粪便绝无脓血），便后胀痛缓解（符合肠易激综合征的腹痛特点），受凉及紧张后症状加重（精神、饮食等因素常诱使肠易激综合征症状复发或加重）。粪隐血试验阴性。综合该患者的病史、实验室检查，考虑诊断为肠易激综合征，需做结肠镜排除器质性病变（A对）。肠易激综合征肠道无细菌感染，所以粪细菌培养（B错）无意义。腹部CT（C错）、腹部B型超声（E错）对空腔脏器疾病的诊断价值不大。小肠X线钡剂造影（D错）是确诊肠道疾病的次选检查，效果次于结肠镜。